下列关于原核细胞型微生物的描述，正确的是
A. 细胞核中有核膜、核仁
B. 以真菌为代表
C. 只能在活细胞内生长繁殖
D. 细胞器很不完善，只有核糖体
E. DNA与RNA不同时存在

正确答案：D。细胞器很不完善，只有核糖体

解析：本题考查原核细胞型微生物。关于原核细胞型微生物的描述正确的是细胞器很不完善，只有核糖体（D对）。原核细胞型微生物的原始核呈环状裸DNA团块结构，无核膜、核仁（A错）；细胞器很不完善，只有核糖体；DNA和RNA同时存在（E错）；细菌的种类繁多，包括细菌、支原体、衣原体、立克次体、螺旋体和放线菌等，不包括真菌（B错），真菌为真核细胞型微生物。原核细胞型微生物中立克次体、衣原体只能在活细胞内生长繁殖，其余均可在无生命培养基中生长繁殖（C错）。